人群一定时期内（通常为一年）在目标生存年龄（通常为70岁或出生期望寿命）以内死亡所造成的寿命减少的总人年数指的是
A. 减寿人年数
B. 无残疾期望寿命
C. 活动期望寿命
D. 伤残调整生命年
E. 健康期望寿命

正确答案：A。减寿人年数